髋关节屈曲挛缩的阳性体征是
A. Froment试验
B. Dugas征
C. Eaton试验
D. Thomas征
E. Mills征

正确答案：D。Thomas征

解析：髋关节屈曲挛缩的阳性体征是Thomas征（D对）。该实验多用来检查髋关节有无屈曲畸形，具体方法如下：病人平卧于检查床上，检查者将其健侧髋、膝关节完全屈曲，使膝部贴住或尽可能贴近前胸，此时腰椎前凸完全消失而腰背平贴于床面，若患侧存在屈曲畸形，即能一目了然，根据大腿与床面所成之角度，断定屈曲畸形为多少。Froment征（A错）（P645）见于尺神经损伤。Dugas征（B错）（P631）阳性见于肩关节脱位。Eaton试验（C错）（P726）即牵拉试验，阳性见于神经根型颈椎病。Mills征（E错）（P719）即伸肌腱牵拉试验，阳性见于肱骨外上髁炎。